男，20岁，苍白、乏力一周。淋巴结及脾大，白细胞计数32.0×10⁹/L，骨髓中原始细胞占83%，过氧化物酶染色阴性。最适宜的化疗方案是
A. DA方案
B. HA方案
C. HOAP方案
D. VDP方案
E. CHOP方案

正确答案：D。VDP方案

解析：患者最可能的诊断是急性淋巴细胞白血病，急性淋巴细胞白血病（ALL）患者常用的治疗方案为VP（长春新碱+泼尼松）、VDP（长春新碱+柔红霉素+泼尼松）、DVLP（柔红霉素+长春新碱+左旋门冬酰胺酶+泼尼松）方案，故患者最适宜的化疗方案是VDP方案（D对）。DA方案（柔红霉素+阿糖胞苷）（A错）、HA方案（高三尖杉酯碱+阿糖胞苷）（B错）是急性髓系白血病（AML）常用的化疗方案（P576）；HOAP方案（高三尖杉酯碱+长春新碱+阿糖胞苷+强的松）（C错）可用于急性粒细胞性白血病及急性单核细胞白血病的治疗；CHOP方案（环磷酰胺+阿霉素+长春新碱+泼尼松）（P590）（E错）是侵袭性非霍奇金淋巴瘤的标准治疗方案。